某男，50岁。久患气管炎，近日咳嗽气喘、痰黄、浮肿尿多。医师处方时常将桑白皮与葶苈子同用，是因此二者除均能利水消肿外，又均能
A. 泻肺平喘
B. 清肺平喘
C. 温肺平喘
D. 泻下平喘
E. 纳气平喘

正确答案：A。泻肺平喘

解析：本题考查的是桑白皮与葶苈子的功效。医师处方时常将桑白皮与葶苈子同用，是因此二者除均能利水消肿外，又均能利水消肿（A对）。桑白皮：【功效】泻肺平喘，利水消肿。葶苈子：【功效】泻肺平喘，利水消肿。马兜铃：【功效】清肺化痰，止咳平喘（B错），清肠疗痔。磁石：【功效】镇惊安神，平肝潜阳，聪耳明目，纳气平喘（E错）。功效为温肺平喘（C错）或泻下平喘（D错）的中药，2022年考试指南未明确说明。